若无禁忌症，治疗2型糖尿病首选的口服降糖药物
A. 沙格列汀
B. 达格列净
C. 吡格列酮
D. 二甲双胍
E. 瑞格列奈

正确答案：D。二甲双胍

解析：本题考查口服降糖药。若无禁忌症，治疗2型糖尿病首选的口服降糖药物是二甲双胍（D对）。二甲双胍为双胍类口服降糖药，首选用于单纯饮食控制及体育锻炼治疗无效的2型糖尿病，特别是肥胖的2型糖尿病。对磺酰脲类药疗效较差的糖尿病患者与磺酰脲类口服降血糖药合用。沙格列汀（A错）为二肽基肽酶-4（DPP4）抑制剂。达格列净（B错）属于钠-葡萄糖协同转运蛋白-2（SGLT-2）抑制药。吡格列酮（C错）属于噻唑烷二酮类胰岛素增敏剂，用于2型糖尿病的控制与改善。瑞格列奈（E错）属于非磺酰脲类胰岛素分泌促进剂。